反映疾病危害居民生命健康严重程度的指标有
A. 某病病死率、死亡率
B. 某病患病率、发病率
C. 某病病死率、发病率
D. 某病死亡率、患病率
E. 以上都不是

正确答案：A。某病病死率、死亡率